α-糖苷酶抑制剂适宜给药时间是
A. 清晨
B. 餐前
C. 餐中
D. 餐后
E. 睡前

正确答案：C。餐中

解析：本题考查药品服用的适宜时间。α-糖苷酶抑制剂是降糖药，需要在餐中（C对）服用，可以减少降糖药对胃肠道的刺激。适宜清晨（A错）服用的药物有糖皮质激素类、抗高血压药物、利尿药、驱虫药、泻药。适宜餐前（B错）服用的药物有胃黏膜保护剂、收敛药、促胃动力药、广谱抗线虫药。适宜餐后（D错）服用的药物有非甾体抗炎药、维生素、组胺H₂受体阻断剂。适宜睡前（E错）服用的药物有催眠药、平喘药、调节血脂药、缓泻药等。